属于水溶性软膏基质的有
A. 蜂蜡
B. 甘油明胶
C. 聚乙二醇
D. 液状石蜡
E. 甲基纤维素

正确答案：C、E。聚乙二醇；甲基纤维素

解析：本题考查的是水溶性软膏基质。属于水溶性软膏基质的有聚乙二醇（C对）与甲基纤维素（E对）。软膏剂、乳膏剂的基质的代表品种：1.油脂性基质：油脂性基质主要包括油脂类、类脂类、烃类和硅酮类。（1）油脂类：常用的有动、植物油，氢化植物油等。植物油常与熔点较高的蜡类熔合制成稠度适宜的基质，如中药油膏常用麻油与蜂蜡熔合为基质。（2）类脂类：①羊毛脂：又称无水羊毛脂。②蜂蜡（A错）：有黄蜡、白蜡之分。此类还有虫白蜡、鲸蜡等。（3）烃类：系石油分熘得到的多种高级烃的混合物，大部分为饱和烃类。①凡士林：有黄、白两种。②石蜡与液态石蜡（D错）。（4）硅酮类：为有机硅氧化物的聚合物，俗称硅油。常用二甲硅油。2.乳状液型基质：①水包油（O/W）型乳膏剂基质：水包油型乳化剂有钠皂、三乙醇胺皂类、脂肪醇型硫酸钠类和聚山梨酯类。②油包水（W/O）型乳剂基质：油包水型乳化剂有钙皂、羊毛脂、单甘酯、脂肪醇等。3.水溶性基质：①纤维素衍生物：常用甲基纤维素、羧甲纤维素钠等。②聚乙二醇：为乙二醇的高分子聚合物。甘油明胶（B错）为栓剂的水溶性基质。甘油明胶：系用明胶、甘油与水制成，一般明胶与甘油等量，水应控制在10%以下。具有弹性，不易折断，在体温下能软化并缓慢溶于分泌液中。常用作阴道栓剂基质，但不适用于鞣酸等与蛋白质有配伍禁忌的药物。